患者咳嗽。查体：气管向左偏移，右侧胸廓较左侧饱满，叩诊出现鼓音。应首先考虑的是
A. 右侧气胸
B. 左侧肺不张
C. 右下肺炎
D. 肺气肿
E. 右侧胸腔积液

正确答案：A。右侧气胸

解析：该患者出现咳嗽症状后，查体见气管向左偏移（气管移位可考虑患者存有胸腔、肺、纵隔及单侧甲状腺的病变）、右侧胸廓较左侧饱满（右侧胸廓饱满、气管向健侧即左侧偏移提示右侧气胸或胸腔积液病变），叩诊出现鼓音（提示有胸膜腔积气），根据病史和查体，应首先考虑为右侧气胸（A对）。左侧肺不张（B错）时，左胸可出现凹陷，叩诊呈浊音，不会出现叩诊鼓音。右下肺炎（C错）时，气管无移位，右下肺叩诊呈浊音或实音。肺气肿（D错）时气管无移位，叩诊呈过清音。右侧胸腔积液（人卫八版诊断学P136）（E错）时，可出现气管向左侧移位，但积液区叩诊为浊音，积液区下部浊音明显，多呈实音。